3天。便稀有黏液，肛门灼热，舌红，苔黄腻，治疗应选取哪组经脉为主
A. 手阳明、足太阴经
B. 足阳明、足太阴经
C. 手阳明、足阳明经
D. 手太阳、足阳明经
E. 任脉、足阳明经

正确答案：C。手阳明、足阳明经

解析：患者腹泻3天，为泄泻病，由肛门灼热，舌红，苔黄腻，判断为胃肠湿热证。除选择主穴，还应配伍内庭（足阳明胃经）、曲池（手阳明大肠经）等穴以清热除湿，若脾虚泄泻宜选用足太阴经穴（AB错）以健脾化湿，此胃肠湿热证应选择手阳明、足阳明经穴以清热除湿（C对）。手太阳经与任脉与此病关系不大（DE错）。